患者女，67岁，出现认知功能障碍5年，诊断为阿尔茨海默病，予以美金刚治疗。下列药物中，可增加美金刚血药浓度的是
A. 氯化铵
B. CYP2D6抑制剂
C. 碳酸氢钠
D. CYP3A4抑制剂
E. CYP2C9抑制剂

正确答案：C。碳酸氢钠

解析：本题考查药物相互作用。可增加美金刚血药浓度的药物是碳酸氢钠（C对）。碳酸氢钠可降低美金刚的清除率而使药物血浆浓度升高。氯化铵（A错）为解热镇痛及非甾体抗炎药，用于痰黏稠不易咳出者，也用于泌尿系统感染需酸化尿液时。CYP2D6抑制剂（B错）、CYP3A4抑制剂（D错）和CYP2C9抑制剂（E错）均为常见的CYP450酶抑制剂，药物作为CYP450的抑制剂可以使药酶活性减弱，使其本身或其它药物代谢减慢。